以上哪种类型的义齿适用于游离端缺失者
A. 金属铸造支架式义齿
B. 黏膜支持式义齿
C. 牙与黏膜混合支持式义齿
D. 胶连式义齿
E. 牙支持式义齿

正确答案：C。牙与黏膜混合支持式义齿

解析：牙与黏膜混合支持式义齿适用于缺失牙数目多，缺隙长，尤其是有游离端缺失者。掌握“局部义齿类型，肯氏分类及模型观测”知识点。